在肾脏产生的激素是
A. 皮质醇
B. 醛固酮
C. 肾上腺素
D. 去甲肾上腺素
E. 肾素

正确答案：E。肾素

解析：肾素（E对）是由肾脏颗粒细胞自身分泌的的激素，在肾脏产生。肾上腺是位于肾脏上方的内分泌器官，不属于肾脏，肾上腺分为皮质和髓质两部分，肾上腺皮质分泌肾上腺皮质激素，包括盐皮质激素、糖皮质激素和性激素。皮质醇（A错）属于糖皮质激素。醛固酮（B错）属于盐皮质激素。肾上腺髓质分泌肾上腺髓质激素，主要包括肾上腺素和去甲肾上腺素（CD错）。